《精神卫生法》关于精神障碍医学鉴定的要求是
A. 鉴定人应当对鉴定过程实时记录并签名
B. 就诊者未经精神障碍医学鉴定，医疗机构不得实施住院治疗
C. 不能确定就诊者为严重精神障碍的应当经医学鉴定
D. 鉴定报告应当经精神障碍患者或者其监护人签字同意
E. 鉴定人不应当到收治精神障碍患者的医疗机构面见、询问患者

正确答案：A。鉴定人应当对鉴定过程实时记录并签名

解析：根据《精神卫生法》的相关规定：鉴定人应当对鉴定过程实时记录并签名（A对）。患者或者其监护人对再次诊断结论有异议的，可以自主委托依法取得执业资质的鉴定机构进行精神障碍医学鉴定（所以精神障碍的鉴定不用于诊断精神障碍的严重程度（C错））。鉴定人面见询问患者时鉴定人应当到收治精神障碍患者的医疗机构面见、询问患者（E错），且该医疗机机构应当予以配合。精神障碍患者已经发生伤害自身的行为，或者有伤害自身的危险情形的，经其监护人同意，医疗机构应当对患者实施住院治疗；监护人不同意的，医疗机构不得对患者实施住院治疗（入院治疗不是取决于精神鉴定而是取决于患者本人或者监护人（B错））。鉴定人本人或者其近亲属与鉴定事项有利害关系， 可能影响其独立、客观、公正进行鉴定的，应当回避所以一般的情况下对精神病人进行鉴定的话，应该是申请书由监护人签字，鉴定报告不会由监护人签字（D错）。